何者错误
A. 脑的被膜最外层为硬脑膜
B. 脊髓的被膜最外层为硬脊膜
C. 硬脊膜紧贴椎管内面
D. 硬脑膜贴颅骨内面
E. 硬脑膜在颅底附着更紧

正确答案：C。硬脊膜紧贴椎管内面

解析：脑的被膜由外向内依次为硬脑膜（A对）、脑蛛网膜和软脑膜，其中硬脑膜为双层膜，外层贴颅骨内面（D对），与颅盖骨连接疏松，在颅底则附着更紧（E对）。脊髓的被膜由外向内为硬脊膜（B对）、脊髓蛛网膜和软脊膜。其中硬脊膜外围为椎管内面骨膜，但两者并非紧贴（C错，为本题正确答案），而是存在间隙称硬膜外隙，内含疏松结缔组织、脂肪、淋巴管、静脉丛和脊神经根等。